后纵韧带
A. 连结相邻两个椎体
B. 连结相邻两椎弓板
C. 位于椎体后面
D. 位于椎体前面
E. 位于相邻棘突之间

正确答案：C。位于椎体后面

解析：后纵韧带位于椎体后面（C对），前纵韧带位于椎体前面（D错），黄韧带位于椎弓板之间（B错），棘间韧带位于相邻棘突之间（E错）。椎间盘连接相邻两个锥体（A错）。